小儿卵圆孔解剖上关闭的时间是
A. 生后1～2岁
B. 生后3～4个月
C. 生后3个月内
D. 生后5～7个月
E. 生后8～10个月

正确答案：D。生后5～7个月

解析：小儿卵圆孔解剖上关闭的时间是生后5-7个月（D对）。80%的小儿动脉导管解剖上关闭的时间是生后3个月内（C错）。